外洗治疮癣宜用
A. 金樱子
B. 乌梅
C. 椿皮
D. 桑螵蛸
E. 乌贼骨

正确答案：C。椿皮

解析：本题考查的是椿皮的主治病证。外洗治疮癣宜用椿皮（C对）。椿皮：【主治病证】（1）久泻久痢，湿热泻痢，便血。（2）崩漏，赤白带下。（3）蛔虫病。（4）疮癣作痒。金樱子（A错）：【主治病证】（1）遗精滑精，尿频遗尿。（2）久泻久痢。（3）崩漏带下。乌梅（B错）：【主治病证】（1）肺虚久咳。（2）久泻久痢。（3）虚热消渴。（4）蛔厥腹痛。（5）崩漏，便血。桑螵蛸（D错）：【主治病证】（1）肾阳亏虚之遗精、滑精，遗尿、尿频，小便白浊，带下。（2）阳痿不育。乌贼骨（E错）为海螵蛸的别名。海螵蛸：【主治病证】（1）崩漏下血，肺胃出血，创伤出血。（2）肾虚遗精，赤白带下。（3）胃痛吞酸。（4）湿疮湿疹，溃疡不敛。